6-甲氧基-7-羟基香豆素的H-3信号是
A. δ7.60（1H,d,J=9.5Hz）
B. δ6.85（1H, brs）
C. δ6.26（1H,d,J—9.5Hz）
D. δ3.95（3H,s）
E. δ6.91（1H.s）

正确答案：C。δ6.26（1H,d,J—9.5Hz）